宫颈癌最常见的组织类型是
A. 高分化鳞癌
B. 中分化鳞癌
C. 低分化鳞癌
D. 高分化腺癌
E. 低分化腺癌

正确答案：B。中分化鳞癌

解析：宫颈癌最常见的组织类型是中分化鳞癌（B对），宫颈癌中，鳞癌占75%-80%，其中中分化鳞癌最常见。